女童，7岁，右下第一恒磨牙窝洞着色且能卡住探针，疑有龋坏，医生为该儿童选择的防治措施是
A. 窝沟封闭
B. 玻璃离子充填
C. 局部用氟
D. ART
E. 充填治疗

正确答案：A。窝沟封闭

解析：窝沟封闭的适应证：深的窝沟，特别是可以插入或卡住探针的牙（包括可疑龋）。若对侧同名牙患龋或有患龋倾向的牙可考虑进行窝沟封闭。牙萌出后达咬合平面即适宜做窝沟封闭，一般是在牙萌出后4年之内。乳磨牙在3～4岁，第一恒磨牙在6～7岁，第二恒磨牙在11～13岁为最适宜封闭的年龄。釉质发育不全，（牙合）面有充填物但存在未做封闭的窝沟，可根据具体情况决定是否做封闭。总之，封闭的最佳时机是牙齿完全萌出，龋尚未发生的时候。适应证则取决于儿童牙齿的解剖情况、龋病活跃性、患龋的风险及儿童合作情况。掌握“窝沟封闭术”知识点。